关于牙龈瘤的起因下列描述正确的是
A. 激素代谢紊乱
B. 刷牙次数过多
C. 机械刺激及慢性炎症刺激
D. 自发性病变，无明确原因
E. 家族遗传性

正确答案：C。机械刺激及慢性炎症刺激

解析：牙龈瘤来源于牙周膜及颌骨牙槽突的结缔组织。大多认为是机械刺激及慢性炎症刺激形成的反应性增生物，因其无肿瘤特有的结构，故非真性肿瘤；但牙龈瘤有肿瘤的外形及生物学行为，如切除后易复发等。此外，牙龈瘤与内分泌有关，如妇女怀孕期间容易发生牙龈瘤，由于雌激素升高所致，分娩后则缩小或停止生长。掌握“牙龈瘤”知识点。